关于流产，下列哪项是正确的
A. 完全流产，有腹痛，宫口松
B. 先兆流产，出血量少，宫口闭
C. 不全流产，宫口闭，出血少
D. 难免流产，宫口闭，出血少
E. 稽留流产，胚胎死亡达4周以上未自然排出

正确答案：B。先兆流产，出血量少，宫口闭

解析：A应是腹痛逐渐消失。宫颈口己闭。C应是子宫出血持续不止，宫颈口已扩张，不断有血液自宫颈口内流出；D阴道流血量增多宫颈口已扩张；E无4周的定义掌握“自然流产”知识点。